火麻仁的功效是
A. 润肠通便
B. 利水消肿
C. 养心安神
D. 止咳平喘
E. 补肾助阳

正确答案：A。润肠通便

解析：本题考查火麻仁的功效。火麻仁的功效是润肠通便（A对）。火麻仁【功效】润肠通便。郁李仁【功效】润肠通便，利水消肿（B错）。刺五加【功效】补气健脾，益肾强腰，养心安神（C错），活血通络。马兜铃【功效】清肺化痰，止咳平喘（D错），清肠疗痔。海马【功效】补肾助阳（E错），活血散结，消肿止痛。